医师在旅游途中救治了一位突发心脏病的旅客，该医师遵循的是
A. 道德义务
B. 法律义务
C. 政治义务
D. 医师职权
E. 岗位职责

正确答案：A。道德义务

解析：医患关系的内容包括：法律权利和法律义务、道德权利和道德义务。医师在旅游途中救治了一位突发心脏病是的旅客，属于在正常的医疗活动之外救治急危重症患者。该案例中医师遵循的是道德义务（A对）。